吸烟对牙周组织的影响，不包括
A. 减低局部氧张力
B. 抑制成纤维细胞的生长
C. 抑制中性粒细胞的功能
D. 不利于口腔卫生维护
E. 抑制胶原酶活性

正确答案：E。抑制胶原酶活性

解析：本题考查吸烟对牙周组织的影响。胶原酶的活性（E错，为本题的正确答案）与吸烟无关。吸烟会破坏口腔环境，不利于口腔卫生维护（D对），吸烟者口腔卫生一般较差，牙面菌斑沉积多，牙石形成增加，舌侧牙龈退缩。吸烟会降低局部氧张力（A对），有利于某些致病菌的生长。吸烟不仅会直接抑制中性粒细胞的功能（C对）和单核-吞噬细胞的功能，而且会减少血清IgG、IgM和sIgA。吸烟会抑制成纤维细胞的生长（B对）并使其不易附着于根面，影响创口愈合，还抑制成骨细胞，导致骨质疏松和骨吸收。